对肩关节有外旋作用的肌
A. 冈上肌
B. 冈下肌
C. 大圆肌
D. 胸大肌
E. 背阔肌

正确答案：B。冈下肌

解析：冈上肌（A错）使肩关节外展。冈下肌（B对）对肩关节有外旋作用。大圆肌（C错）使肩关节后伸，内收、旋内。胸大肌（D错）使使肩关节内收、旋内和前屈。背阔肌（E错）使肩关节后伸、内收及旋内。